患者，男，56岁，体检发现血尿酸530μmol/L（参考值＜420μmol），患者向药师咨询维生素使用问题，药师应告知患者可引起尿酸升高的维生素是
A. 维生素B₁₂
B. 维生素C
C. 维生素B₂
D. 维生素B₆
E. 维生素E

正确答案：B。维生素C

解析：本题考查引起高尿酸血症的维生素。药师应告知患者可引起尿酸升高的维生素是维生素C（B对）。可致血尿酸升高的药物：阿司匹林、贝诺酯、氢氯噻嗪、胰岛素、青霉素、维生素C、维生素B₁、吡嗪酰胺等。